6岁男孩，自幼营养欠佳，较瘦小，可见方颅、肋膈沟和“O”形腿。查：血钙稍低，血磷降低，X线示干骺端临时钙化带呈毛刷样，考虑其确切的诊断是
A. 营养不良
B. 维生素D缺乏性佝偻病
C. 维生素D缺乏性手足搐搦症
D. 抗维生素D佝偻病
E. 软骨营养不良

正确答案：B。维生素D缺乏性佝偻病

解析：6岁男孩，自幼营养欠佳，较瘦小，可见方颅、肋膈沟和“O”形腿。查：血钙稍低，血磷降低，X线示干骺端临时钙化带呈毛刷样等符合维生素D缺乏性佝偻病（B对）的临床表现及X线检查结果。而营养不良（P65）（A错）主要表现为体重低下、生长迟缓和消瘦等，不会出现方颅、肋膈沟和“O”形腿等表现，故该患儿不考虑此病。（P81）维生素D缺乏性手足搐搦症（C错）多见于6个月以内的小婴儿，现已较少见，主要为惊厥、喉痉挛和手足搐搦，并伴有程度不等的活动期佝偻病表现，故该患儿不考虑此病。（P79）抗维生素D病（D错）多为性连锁遗传，亦可为常染色体显性或隐性遗传，也有散发病例，为肾小管重吸收磷及肠道吸收磷的原发性缺陷所致。佝偻病的症状多发生于1岁以后，血钙多正常，血磷明显降低，尿磷增加，用一般治疗剂量维生素D治疗佝偻病无效时可与维生素D缺乏性佝偻病相鉴别。软骨营养不良（E错）是一种遗传性软骨发育障碍，出生时即可见四肢短、头大、前额突出、腰椎前凸、臀部后凸等，故该患儿不考虑此病。